男，27岁，烧伤6h，烧伤总面积60%，面颈及双上肢为深Ⅱ度至Ⅲ度烧伤，鼻毛烧焦，声嘶，近1h来患者出现进行性呼吸困难，目前患者神志不清，心率120次/分，呼吸4～8次/分，呈叹息样。首选治疗方案是上述哪项
A. 气管切开
B. 气管插管
C. 鼻饲给氧
D. 静脉切开或静脉穿刺插管
E. 静脉穿刺

正确答案：B。气管插管

解析：病人烧伤面积主要在面颈部，加之病人出现呼吸困难，所以急救时应该使气道通畅，可行气管插管。掌握“火器伤、热烧伤”知识点。